天麻钩藤颗粒主治高血压病证属肝阳上亢，症见头痛、眩晕、耳鸣、眼花、震颤、失眠等，其处方组成的臣药是
A. 牛膝
B. 钩藤
C. 盐杜仲
D. 石决明
E. 桑寄生

正确答案：D。石决明

解析：本题考查的是天麻钩藤颗粒的方义简释。天麻钩藤颗粒主治高血压病证属肝阳上亢，症见头痛、眩晕、耳鸣、眼花、震颤、失眠等，其处方组成的臣药是石决明（D对）。天麻钩藤颗粒：【方义简释】方中天麻甘缓质重，柔润不燥，性平不偏，善平肝息风、通络止痛，治肝风、肝阳之头痛、头晕；钩藤（B错）甘缓平和，微寒清泄，质轻疏透，善平肝阳、息肝风，兼清肝热。两药相伍，平肝息风力胜，故为君药。石决明介类质重镇潜，咸寒清泄兼补，善平肝潜阳、清肝益阴，既增君药平肝息风之力，又兼清肝益阴，故为臣药。盐杜仲（C错）甘补而温，善补益肝肾、降血压；栀子苦寒降泄清利，善泻火除烦、清热利尿、凉血解毒；黄芩苦寒清泄而燥，善清热泻火；益母草辛散苦泄，微寒清利，善活血化瘀、清热利尿；桑寄生（E错）苦燥甘补，平而不偏，善补肝肾；首乌藤甘能补，藤通散，平不偏，善养血安神通络；茯苓甘淡渗利兼补，平而不偏，善健脾利湿、宁心安神。七药相合，既补肝益肾、活血利水以利平抑肝阳，又折其上扰之火以利清热，并兼安神，故为佐药。牛膝（A错）酸甘能补，苦泄下行，性平不偏，既善补肝益肾、活血，又引血、引火下行，以利于平抑肝阳，故为使药。全方配伍，潜降清泄补益，共奏平肝息风、清热安神之功，故善治肝阳上亢所致的头痛、眩晕、耳鸣、眼花、震颤、失眠，以及高血压病见上述证候者。